麻疹出疹一般在发热后的
A. 1～2天
B. 3～4天
C. 5～6天
D. 7～8天
E. 9～10天

正确答案：B。3～4天

解析：麻疹出疹一般在发热后的3～4天（B对），皮疹形成的原因主要是局部产生超敏反应，其机制为呼吸道进入的病毒首先与呼吸道上皮细胞受体结合并在其中增殖，继之侵入淋巴结增殖，然后入血（在白细胞内增殖良好），形成第一次病毒血症。病毒到达全身淋巴组织大量增殖再次入血，形成第二次病毒血症。此时开始发热，继之由于病毒在结膜、鼻咽粘膜和呼吸道粘膜等处增殖而出现上呼吸道卡他症状。病毒也在真皮层内增殖，口腔两颊内侧粘膜出现中心灰白、周围红色的Koplik斑。